低嘌呤膳食不包括
A. 精制谷类
B. 牛奶
C. 鸡蛋
D. 水果
E. 肉汤

正确答案：E。肉汤

解析：本题考查低嘌呤膳食。低嘌呤膳食是指限制嘌呤摄入量，降低血清尿酸水平，增加尿酸排泄的膳食。主要包括精制谷类（A对）、牛奶（B对）、鸡蛋（C对）、水果（D对）等。肉汤（E错，为本题正确答案）中所含嘌呤量较高。